栓剂常用的水溶性基质有
A. PEG
B. Tween-61
C. Myri52
D. 泊洛沙姆
E. CMC-Na

正确答案：A、B、C、D。PEG；Tween-61；Myri52；泊洛沙姆

解析：本题考查栓剂的基质。PEG（A对）即聚乙二醇、Tween-61（B对）、Myri52（C对）、泊洛沙姆（D对）为栓剂常用的水溶性基质；CMC-Na（E错）可作为软膏剂的水溶性基质。